某女性患者，38岁。牙龈自发性出血1年半就诊。检查：舌缘、两颊黏膜多处瘀斑，患者自述平时轻微碰撞皮肤即会出现瘀斑。血常规检查：血小板计数30×10⁹/L。最可能的诊断是
A. 再生障碍性贫血
B. 白血病
C. 血小板减少性紫癜
D. 粒细胞减少症
E. 血友病

正确答案：C。血小板减少性紫癜

解析：本题考查血小板减少性紫癜的临床表现。某女性患者，38岁。牙龈自发性出血1年半就诊。检查：舌缘、两颊黏膜多处瘀斑，患者自述平时轻微碰撞皮肤即会出现瘀斑。血常规检查：血小板计数30×10⁹/L（正常值为100～ 300×10⁹/L），最可能的诊断是血小板减少性紫癜（C对）。再生障碍性贫血（A错）只一种可能可能由不同病因和机制引起的骨髓造血功能衰竭症，主要表现为骨髓造血功能低下、全血细胞减少和贫血、出血、感染综合征，免疫抑制治疗有效。白血病（B错）是一类造血干祖细胞的恶性克隆性疾病，因白血病细胞自我更新增强、增殖失控、分化障碍、凋亡受阻，而停滞在细胞发育的不同阶段。在骨髓和其他造血组织中，白血病细胞大量增生累积，使正常造血受抑制并浸润其他器官和组织，主要表现为贫血、发热、出血等正常骨髓造血功能受抑制表现及淋巴结和肝脾肿大等白血病细胞增殖浸润的表现。粒细胞减少症（D错）指外周血中性粒细胞绝对计数，在成人低于2.0×l0⁹/L，在儿童≥10岁低于1.8×l0⁹/L或＜10岁低于1.5×10⁹/L，轻度减少的患者临床上不出现特殊症状，多表现为原发病症状。中度和重度减少者易发生感染和出现疲乏、无力、头晕、食欲减退等非特异性症状；常见的感染部位是呼吸道、消化道及泌尿生殖道，可出现高热、黏膜坏死性溃疡及严重的败血症、脓毒血症或感染性休克。血友病（E错）是一组因遗传性凝血活酶生成障碍引起的出血性疾病，包括血友病A和血友病B，其中以血友病A较为常见；血友病以阳性家族史、幼年发病、自发或轻度外伤后出血不止、血肿形成及关节出血为特征。